下列细胞中吞噬能力最强的是
A. 单核巨噬细胞
B. 淋巴细胞
C. 中性粒细胞
D. 嗜酸性粒细胞
E. 嗜碱性粒细胞

正确答案：A。单核巨噬细胞